不属于Spee曲线特点的是
A. 为下颌牙列的纵牙合曲线
B. 形成一条凹向上的曲线
C. 连接下颌切牙嵴、尖牙牙尖及前磨牙、磨牙的颊尖
D. 在切牙段较平
E. 自尖牙起向后逐渐降低，到第二磨牙远中颊尖处最低

正确答案：E。自尖牙起向后逐渐降低，到第二磨牙远中颊尖处最低

解析：本题考查Spee曲线的特点。不属于Spee曲线特点的是自尖牙起向后逐渐降低，到第二磨牙远中颊尖处最低（E错，为本题的正确答案）。Spee曲线为下颌牙列的纵（牙合）曲线（A对），形成一条凹向上的曲线（B对），连接下颌切牙嵴、尖牙牙尖及前磨牙、磨牙的颊尖（C对）。Spee曲线在切牙段较平（D对），从尖牙向后经前磨牙至第一磨牙的远颊尖是逐渐减低的，但是到第二、第三磨牙的颊尖又开始逐渐升高。